某男，26岁，素体肺气不足，感受风邪出现鼻痒、喷嚏、流清涕，宜选用的成药是
A. 鼻渊舒胶囊
B. 辛芩颗粒
C. 鼻炎康片
D. 千柏鼻炎片
E. 藿胆丸

正确答案：B。辛芩颗粒

解析：本题考查的是辛芩颗粒的主治。体肺气不足，感受风邪出现鼻痒、喷嚏、流清涕，宜选用的成药是辛芩颗粒（B对）。辛芩颗粒：【主治】肺气不足、风邪外袭所致的鼻痒、喷嚏、流清涕、易感冒；过敏性鼻炎见上述证候者。鼻渊舒胶囊（A错）：【主治】鼻炎、鼻窦炎属肺经风热及胆腑郁热证者。鼻炎康片（C错）：【主治】风邪蕴肺所致的急、慢性鼻炎，过敏性鼻炎。千柏鼻炎片（D错）：【主治】风热犯肺、内郁化火、凝滞气血所致的鼻塞、鼻痒气热、流涕黄稠、或持续鼻塞、嗅觉迟钝；急慢性鼻炎、急慢性鼻窦炎见上述证候者。藿胆丸（E错）：【主治】湿浊内蕴、胆经郁火所致的鼻塞、流清涕或浊涕、前额头痛。